阿司匹林与对乙酰氨基酚、咖啡因联合使用的目的是
A. 利用药物间的拮抗作用，克服某些药物的毒副作用
B. 产生协同作用，增强药效
C. 减少或延缓耐药性的发生
D. 形成可溶性复合物，有利于吸收
E. 改变尿液pH，有利于排泄

正确答案：B。产生协同作用，增强药效

解析：本题考查药物的配伍变化。阿司匹林、对乙酰水杨酸、咖啡因共同发挥作用，疗效会显著增强（B对）；利用药物间的拮抗作用，克服某些药物的毒副作用（A错），如吗啡与阿托品；减少或延缓耐药性的发生（C错），如阿莫西林与克拉维酸。